先天性巨结肠最常见的并发症是
A. 营养不良
B. 败血症
C. 肠穿孔
D. 小肠结肠炎
E. 肠梗阻

正确答案：D。小肠结肠炎

解析：先天性巨结肠最常见的并发症是小肠结肠炎（D对），尤其多见于新生儿，主要表现为高热、高度腹胀、呕吐、排出恶臭并带血的稀便。该病的其他并发症还有肠穿孔和继发感染，但临床上较少见。